一氧化碳中毒的患者，出现发绀，呼吸困难的原因是因为
A. 血红蛋白对氧气的亲和力下降
B. 氧解离曲线右移
C. 肺弥散功能障碍
D. 碳氧血红蛋白的形成
E. 通气功能障碍

正确答案：D。碳氧血红蛋白的形成

解析：COHb与血红蛋白中的血红素部分结合，抑制其他3个氧结合位点释放氧至外周组织的能力，导致血红蛋白氧解离曲线左移，加重组织细胞缺氧（D对）。1.虽然有缺氧，但没有发绀 2.曲线左移，O2与Hb亲和力增高，妨碍Hb与O2解离，加重缺氧 3.CO与Hb结合，影响Hb与O2结合 4.PO2通常正常，不刺激呼吸中枢，也不增加肺通气量 5.血氧含量下降